苏子降气汤中配伍当归和肉桂的意义是
A. 温肾纳气
B. 养血补肝
C. 温补下虚
D. 祛痰止咳
E. 温肾祛寒

正确答案：C。温补下虚

解析：该题考查苏子降气汤的方解。苏子降气汤是治疗痰涎壅盛，上实下虚之咳喘的常用方，方中肉桂温补下元，纳气平喘，以治下虚，当归既可治咳逆上气，又能养血补肝润燥，同肉桂以增温补下虚（C对）。